我国医院感染的发生率约为
A. 0.05
B. 0.1
C. 0.15
D. 0.2
E. 0.25

正确答案：B。0.1